男，18岁，受凉后咳嗽，咳少量粘液、脓痰，伴发热，右侧胸痛并右肩及右上腹痛；查体：体温39.1℃，脉搏96次/分，呼吸24次/分；右侧胸廓呼吸动度减弱，语颤增强，右肺下叩诊浊音，可听到支气管呼吸音并响亮的中等湿啰音；血常规化验：白细胞15×10⁹/L，N0.90。该患者的中等湿啰音产生原理是
A. 气体通过气管支气管内的液体，形成水泡随即破裂而产生的声音
B. 气体通过狭窄的气管支气管腔产生震动引起的声音
C. 炎症侵入胸膜，引起脏壁层胸膜粗糙摩擦而产生的声音
D. 是肺部炎症时，实变部分传音良好，支气管呼吸音经肺实变部分传到胸壁的声音
E. 是病人无力排痰，气体通过分泌物积聚的大气道所产生的声音

正确答案：A。气体通过气管支气管内的液体，形成水泡随即破裂而产生的声音

解析：中等湿啰音为气体通过气管支气管内的液体时形成的水泡随即破裂产生的声音（A对）。病人无力排痰，气体通过分泌物积聚的大气道所产生的声音（E错）是粗湿啰音。气体通过狭窄的气管支气管腔产生震动引起的声音（B错）是干啰音。炎症侵入胸膜，引起脏壁层胸膜粗糙摩擦而产生的声音（C错）是胸膜摩擦音。肺部炎症时，实变部分传音良好，支气管呼吸音经肺实变部分传到胸壁的声音（D错）是异常支气管呼吸音。